（109～111题共用题干）男婴，4个月。反复发作性吸入性呼吸困难伴吸气时喉鸣，口唇青紫3次。无发热。发作期间一般情况良好。枕部指压有乒乓球样感，肺、心未见异常。首先考虑的诊断为
A. 气管异物
B. 急性喉炎
C. 支气管肺炎
D. 维生素D缺乏性手足抽搐症
E. 急性喉气管炎

正确答案：D。维生素D缺乏性手足抽搐症

解析：患者男婴，4个月（维生素D缺乏性手足抽搐症的好发人群）。反复发作性吸入性呼吸困难伴吸气时喉鸣，口唇青紫3次（临床反复出现呼吸困难、缺氧表现，提示存在维生素D缺乏性手足抽搐可能）。无发热（排除高热惊厥可能）。发作期间一般情况良好。枕部指压有乒乓球样感（维生素D缺乏性佝偻病的典型体征），肺、心未见异常（排除呼吸循环系统病变导致的呼吸困难）。结合以上临床表现及体格检查，该患儿最有可能是维生素D缺乏性手足抽搐症（D对）。气管异物（A错）会出现吸气性呼吸困难但不会出现枕部指压乒乓球样感。小儿急性喉炎（B错）（P242）多起病急，进展快，可有发热、犬吠样咳嗽、声嘶、吸气性喉鸣和三凹征，严重可出现发绀、心率加快、面色苍白，但无枕部指压乒乓球样感。支气管肺炎（C错）（P253）会出现发热、咳嗽、气促等症状，无颅骨改变。急性喉支气管炎（E错）同样不会出现颅骨病变。